Kussmaul呼吸常见于哪种情况
A. 代谢性碱中毒
B. 代谢性酸中毒
C. 呼吸性碱中毒
D. 呼吸性酸中毒
E. 以上答案均不正确

正确答案：B。代谢性酸中毒

解析：Kussmaul呼吸（库斯莫尔呼吸）是指各种代谢性酸中毒（B对）所导致的深快呼吸，常见于糖尿病酮症酸中毒、尿毒症酸中毒等。